容量负荷过重损害心功能常见于
A. 肺动脉高压
B. 二尖瓣关闭不全
C. 肺栓塞
D. 肺动脉瓣狭窄
E. 心肌病

正确答案：B。二尖瓣关闭不全

解析：心功能不全的病因可分为：心肌收缩性降低、心室负荷过重和心室舒张及充盈受限。心肌病（E错）时，心肌细胞发生变性、坏死及组织纤维化，导致收缩性降低。肺动脉高压（A错）、肺栓塞（C错）、肺动脉瓣狭窄（D错）均导致右心室射血所要克服的阻力增加，即压力负荷增加。二尖瓣关闭不全（B对）导致心脏收缩时左心室有部分血液反流入左心房，使心脏舒张时左心室充盈压升高，即容量负荷增加。